构成肾髓质的主要结构是
A. 肾小盏
B. 肾大盏
C. 肾乳头
D. 肾锥体
E. 肾窦

正确答案：D。肾锥体

解析：构成肾髓质的主要结构是肾锥体（D对）。